某男，37岁。长夏时节，天气由暑热突转阴雨连绵，因着衣不慎，遂致感冒。症见头痛昏重，胸膈满闷，脘腹胀痛，呕吐泄泻，舌苔白腻。证属外感风寒、内伤湿滞之感冒，接诊医师处以藿香正气水。服用2天后症状消失。藿香正气水的功能是
A. 解表化湿，理气和中
B. 解表散寒，祛风胜湿
C. 解表散寒，燥湿和中
D. 解表胜湿，祛风化痰
E. 解表散风，理气和中

正确答案：A。解表化湿，理气和中

解析：本题考查的是藿香正气水的功能。藿香正气水的功能是解表化湿，理气和中（A对）。藿香正气水：【功能】解表化湿，理气和中。解表散寒，祛风胜湿为荆防颗粒的功能（B错）。荆防颗粒：【功能】解表散寒，祛风胜湿。功能为解表散寒，燥湿和中（C错）、解表胜湿，祛风化痰（D错）或解表散风，理气和中（E错）的中成药，2022年考试指南未明确说明。